用样本的信息推断总体，样本应该是
A. 总体中的典型部分
B. 总体中有意义的一部分
C. 从总体中随便抽取的一部分
D. 总体中有价值的一部分
E. 从总体中随机抽取的一部分

正确答案：E。从总体中随机抽取的一部分

解析：本题考查样本的相关内容 。随机抽样是指总体中每个个体有相同的机会被选中作为样本参与调查，从而降低样本的选择偏倚，就像试验研究中通过随机化来降低偏倚一样。根据随机分配机制（E对ABCD错）来进行样本选择可避免样本选择偏倚，这种抽样过程不会融入抽样者或志愿者的主观意愿。